中医学认为肝硬化之病位主要在
A. 肝、胆、脾、胃
B. 肝、胆、肺、肾
C. 肝、心、脾、肾
D. 肝、脾、肾
E. 肝、心、脾

正确答案：D。肝、脾、肾

解析：中医学认为肝硬化的病位主要在肝、脾、肾三脏（D对），基本病机为肝、脾、肾三脏功能失调，气滞、血瘀、水停腹中。病性多属本虚标实，本虚为肝、脾、肾亏损，标实为气滞、血瘀、水停。